下列哪项不是婴幼儿腹泻的治疗原则
A. 尽早使用止泻剂
B. 预防脱水
C. 纠正脱水
D. 继续饮食
E. 合理用药

正确答案：D。继续饮食

解析：婴幼儿腹泻时宜适当控制饮食，减轻脾胃负担（D对）。泄泻宜尽早使用止泻剂，保障患儿身体体液状况（A错）。脱水是泄泻患儿常见并发症，预防并纠正脱水有利于患儿生命体征的维持（BC错）。泄泻患儿宜合理用药（E错）。